多形性腺瘤最佳的治疗方法是
A. 放疗
B. 理疗
C. 剜除术
D. 手术切除
E. 单纯肿瘤摘除

正确答案：D。手术切除

解析：多形性腺瘤的治疗为手术切除，不能作单纯肿瘤摘除，即剜除术，而应作肿瘤包膜外正常组织处切除。腮腺肿瘤应保留面神经，下颌下腺肿瘤应包括下颌下腺一并切除。掌握“多形性腺瘤”知识点。